慢性肺源性心脏病肺、心功能失代偿期表现不准确的是
A. 呼吸困难加重
B. 呼吸困难夜间加重
C. 食欲旺盛
D. 发绀明显，颈静脉怒张
E. 气促加重

正确答案：C。食欲旺盛

解析：慢性肺源性心脏病肺、心功能失代偿期：呼吸衰竭：呼吸困难加重是最常见的症状，以夜间为甚，常伴有头痛、失眠、食欲下降。肺性脑病时出现嗜睡、神志恍惚、谵妄、皮肤潮红、多汗等症状常见体征有明显发组，球结膜充血、水肿，严重时可有视网膜血管扩张、视乳头水肿等。腱反射减弱或消失，可出现病理反射。右心衰竭：常见症状有气促加重，心季、食欲缺乏、腹胀、恶心等。常见体征有发绀明显，颈静脉怒张。心率增快，可出现心律失常，剑突下可闻及收缩期杂音肝大且有压痛肝颈静脉回流征阳性，下肢水肿，重者可有腹水。掌握“慢性肺源性心脏病”知识点。